我国《传染病防治法》规定的甲类传染病包括
A. 鼠疫、艾滋病
B. 鼠疫、霍乱
C. 鼠疫、霍乱、艾滋病
D. 鼠疫、霍乱、伤寒和副伤寒
E. 鼠疫、霍乱、艾滋病、伤寒和副伤寒

正确答案：B。鼠疫、霍乱

解析：甲类传染病：是指鼠疫、霍乱。掌握“传染病的概述”知识点。